下列哪一项是正常结合上皮的组织学特点
A. 无角化，有上皮钉突
B. 无角化，无上皮钉突
C. 正角化，有上皮钉突
D. 不全角化，有上皮钉突
E. 不全角化，无上皮钉突

正确答案：B。无角化，无上皮钉突

解析：本题考查正常结合上皮的组织学特点。正常结合上皮的组织学特点是无角化，无上皮钉突（B对）。结合上皮是牙龈上皮附着在牙表面的一条带状上皮，从龈沟底开始，向根尖方向附着在牙釉质或牙骨质的表面。结合上皮是无角化的鳞状上皮，在龈沟底部约含15～30层细胞，向根尖方向逐渐变薄，约含3～4层细胞。结合上皮细胞呈扁平状，其长轴与牙面长轴平行，无上皮钉突。